人造冠完全到位的标志，不包括
A. 咬合基本良好
B. 无翘动
C. 边缘密合
D. 边缘达到设计位置
E. 接触点松紧度适当

正确答案：E。接触点松紧度适当

解析：本题考查人造冠完全到位的标志。人造冠完全到位的标志，不包括接触点松紧度适当（E错，为本题正确答案）。修复体就位的标志是咬合基本良好（A对），稳定无翘动（B对），边缘密合（C对），龈边缘达到设计位置（D对）。